循环性缺氧时可出现：
A. 氧分压降低和紫绀
B. 氧分压降低但无紫绀
C. 动静脉氧差降低和紫绀
D. 动静脉氧差增高和紫绀
E. 以上都不对

正确答案：D。动静脉氧差增高和紫绀

解析：循环性缺氧时，由于氧的摄入和弥散正常，所以氧分压正常（AB错）。而循环障碍使血液流经组织毛细血管的时间延长，细胞从单位容量血液中摄取的氧量增多，同时由于血流淤滞，二氧化碳含量增加，使氧离曲线右移，释氧增加，动－静脉血氧含量差增大（C错）。另外由于细胞从血液中摄取的氧量较多，毛细血管中脱氧血红蛋白含量增加，易出现紫绀。所以循环性缺氧时可出现动静脉氧差增高和紫绀（D对）。